社会心理因素对个体心身健康的影响最主要的是
A. 应激的强烈程度
B. 应激持续时间
C. 个体的心理状态
D. 社会支持
E. 对信息的主观评价

正确答案：E。对信息的主观评价